丘脑腹后核不接受
A. 对侧躯干、上、下肢深感觉纤维
B. 对侧躯干、上、下肢浅感觉纤维
C. 同侧的深，浅感觉纤维
D. 对侧头面部浅感觉纤维
E. 味觉的纤维

正确答案：C。同侧的深，浅感觉纤维

解析：丘脑腹后核接受对侧头面部的浅感觉（DE对），传导上下肢的深浅感觉（AB对），并不接受同侧的深，浅感觉纤维（C错，为本题正确选项）。